某一种净水器经过对其出水水质的检验显示浊度为0.5，细菌总数为10CFU/ml，溶解性总固体600ml/L，色度3度，砷＜0.01mg/L，据此认为该水质
A. 符合净水器水质卫生要求
B. 浊度不符合净水器水质卫生要求
C. 细菌总数不符合净水器水质卫生要求
D. 溶解性总固体不符合净水器水质卫生要求
E. 色度不符合净水器水质卫生要求

正确答案：A。符合净水器水质卫生要求

解析：本题考查净水器水质卫生要求。根据水质检验结果，浑浊度为0.5（标准规定限值为1度），细菌总数为10CFU/ml（标准规定≤1000FU/ml），溶解性总固体600ml/L（规定含量不超过1000mg/L），色度3度（规定不应超过15度），砷＜0.01mg/L（标准规定含量不得超过0.01mg/L），可认为该水质符合净水器水质卫生要求（A对BCDE错）。